胃苏颗粒除和胃止痛外，又能
A. 疏肝泄热
B. 健脾养心
C. 行气化湿
D. 行气活血
E. 理气消胀

正确答案：E。理气消胀

解析：本题考查的是胃苏颗粒的功能。胃苏颗粒除和胃止痛外，又能理气消胀（E对）。胃苏颗粒【功能】理气消胀，和胃止痛。加味逍遥丸（口服液）【功能】疏肝清热（A错），健脾养血。归脾丸【功能】益气补血，健脾养心（B错）。木香顺气丸（颗粒）【功能】行气化湿（C错），健脾和胃。速效救心丸【功能】行气活血（D错），祛瘀止痛。增加冠脉血流量，缓解心绞痛。